多用于远中孤立的磨牙上，上颌磨牙向近中颊侧倾斜者的卡环
A. 圈形卡环
B. 回力卡环
C. 对半卡环
D. RPI卡坏
E. 三臂卡环

正确答案：A。圈形卡环

解析：圈形卡环：多用于远中孤立的磨牙上，上颌磨牙向近中颊侧倾斜、下颌磨牙向近中舌侧倾斜者。卡环臂的尖端在上颌磨牙的颊侧和下颌磨牙的舌侧。铸造的圈形卡有近、远中两个支托。远中支托有增加支持，防止基牙进一步倾斜移位作用。非倒凹一侧卡环臂有辅助臂与支架相连，可增加卡环臂的强度。掌握“局部义齿固位体”知识点。